红外吸收光谱主要特征峰νC-O的波数是
A. 3750～3000cm⁻¹
B. 2400～2100cm⁻¹
C. 1900～1650cm⁻¹
D. 1300～1000cm⁻¹
E. 1000～650cm⁻¹

正确答案：D。1300～1000cm⁻¹

解析：本题考查红外吸收光谱。红外吸收光谱主要特征峰νC-O的波数是1300～1000cm⁻¹（D对）。一个基团常有数种红外震动形式，其中能引起红外吸收的振动形式为活性振动，特定基团的红外活性振动对应一个特征峰。振动形式为νC-O时所对应的红外峰位为1300～1000cm⁻¹。振动形式为νO-H时所对应的红外峰位为3750～3000cm⁻¹（A错）。振动形式为νC≡C、νC≡N时所对应的红外峰位为2400～2100cm⁻¹（B错）。振动形式为νC=O时所对应的红外峰位为1900～1650cm⁻¹（C错）。振动形式为δ=C-H、δAr-H时所对应的红外峰位为1000～650cm⁻¹（E错）。